螺旋甾烷型皂苷的结构特征有
A. B/C和C/D环反式稠合
B. A/B环反式或顺式稠合
C. C-20位的甲基为β构型
D. C-20位的甲基为α构型
E. C-25位的甲基为α或β构型

正确答案：A、B、D、E。B/C和C/D环反式稠合；A/B环反式或顺式稠合；C-20位的甲基为α构型；C-25位的甲基为α或β构型